外科临床上最常见的酸碱失衡是
A. 呼吸性酸中毒
B. 代谢性酸中毒
C. 呼吸性碱中毒
D. 代谢性碱中毒
E. 呼吸性酸中毒合并代谢性碱中毒

正确答案：B。代谢性酸中毒

解析：外科临床上最常见的酸碱失衡是代谢性酸中毒（B对），是由酸性物质的积聚或产生过多，或HCO₃⁻丢失过多所引起。